初产妇，28岁。妊娠34周，恶心，呕吐，腹胀，黄疸，轻度乏力，诊断妊娠合并急性乙型病毒性肝炎。该患者的治疗是
A. 立即隔离、保肝治疗
B. 立即剖宫产
C. 无需特殊处理，等至顺产
D. 人工引产
E. 严密监护下继续妊娠

正确答案：A。立即隔离、保肝治疗

解析：该初产妇恶心，呕吐，腹胀，黄疸，轻度乏力，已诊断出妊娠合并急性乙型病毒性肝炎，故应采用立即隔离、保肝治疗（A对CE错），使肝功能恢复。若出现重型肝炎症状，则考虑适时终止妊娠，该患者黄疸，轻度乏力，消化道症状未加重，故症状比较轻，不需要行剖宫产（B错）、人工引产（D错）等终止妊娠。